《中国药典》规定，山豆根的内服用量应是
A. 1g～3g
B. 2g～5g
C. 3g～6g
D. 3g～9g
E. 5g～9g

正确答案：C。3g～6g

解析：本题考查的是《中国药典》收载毒性药材和饮片的用法用量。《中国药典》规定，山豆根的内服用量应是3g～6g（C对）。山豆根：有毒，用量3～6g。1g～3g（A错）为水蛭的用量。水蛭：有小毒，用量1～3g。妊娠禁用。2g～5g（B错）为干漆的用量。干漆：有毒，用量2～5g。妊娠禁用。对漆过敏者禁用。3g～9g（D错）为北豆根的用量。北豆根：有小毒，用量3～9g。5g～9g（E错）为常山的用量。常山：有毒，用量5～9g。妊娠慎用。有催吐作用，量不宜过大。